脊髓内交感神经节前神经元胞体所在部位是
A. 骶中间外侧核
B. 中间内侧核
C. 胸核
D. 后角固有核
E. 中间外侧核

正确答案：E。中间外侧核

解析：中间外侧核（E对）是交感神经节前神经元胞体所在的部位，即交感神经的低级中枢，发出纤维经前根进入脊神经，再经白交通支到交感干， 这种节前纤维也来自中间内侧核（B错）的细胞，该核的其余细胞属中间神经元；骶中间外侧核（A错）是副交感神经节前纤维的起始核；胸核（C错）接受后根的传入纤维，发出纤维到脊髓小脑后束和脊髓中间神经元；后角固有核（D错）接受大量的后根传入纤维，发出的纤维联络脊髓的不同节段并进入白质形成纤维束。